延长移植物存活的措施中，防治移植排斥反应最有效的措施是
A. 诱导耐受
B. 组织配型
C. 给予免疫抑制药
D. 放射线照射
E. 交叉配型

正确答案：C。给予免疫抑制药

解析：免疫抑制：防治移植排斥反应最有效的措施是给予免疫抑制药。掌握“移植免疫”知识点。